下列用于治疗药物监测的体内样品中，制备过程需使用抗凝剂的有
A. 全血
B. 血浆
C. 血清
D. 尿液
E. 唾液

正确答案：A、B。全血；血浆

解析：本题考查体内药物检测。用于治疗药物监测的体内样品中，制备过程需使用抗凝剂的有全血（A对）、血浆（B对）。全血和血浆中都含有纤维蛋白原和一些凝血因子，采集后为防止凝结需要加入抗凝剂，而血清中不含上述物质，不需要抗凝剂。尿液（D错）和唾液（E错）的采集均不需要抗凝剂。